慢性呼吸性酸中毒时机体的主要代偿方式是
A. 呼吸代偿
B. 肾脏代偿
C. 细胞内缓冲及细胞内外离子交换
D. 骨骼代偿
E. 细胞外液缓冲

正确答案：B。肾脏代偿

解析：慢性呼吸性酸中毒时机体的主要代偿方式是肾脏代偿（B对），肾脏的调节作用发挥较慢，常在酸碱平衡紊乱发生后12 -24小时才发挥作用，但效率高，作用持久，对排出非挥发酸及保留NaHC03有重要作用。